急性毒性试验常用参数有
A. LD₅₀
B. Zac
C. 剂量-反应曲线
D. LD₈₄/LD₁₆
E. 以上都是

正确答案：E。以上都是